既是原穴，又是八会穴的腧穴是
A. 太渊
B. 合谷
C. 后溪
D. 内关
E. 阳池

正确答案：A。太渊

解析：太渊为手太阴肺经的输穴、原穴，同时也是八会穴之脉会（A对）。合谷为手阳明大肠经的原穴（B错）。后溪为手太阳小肠经的输穴，八脉交会穴（C错）。内关为手厥阴心包经的络穴，八脉交会穴（D错）。阳池为手少阳三焦经的原穴（E错）。